有性欲减退和阳痿不良反应的是
A. 西咪替丁
B. 雷尼替丁
C. 法莫替丁
D. 罗沙替丁
E. 尼扎替丁

正确答案：A。西咪替丁